阴虚血热之失血证宜用
A. 天门冬
B. 百合
C. 玉竹
D. 桑椹
E. 墨旱莲

正确答案：E。墨旱莲

解析：本题考查的是墨旱莲的主治病证。以上药物均属于补阴药。治疗阴虚血热之失血证，宜用墨旱莲（E对）。墨旱莲：【主治病证】（1）肝肾阴虚之头晕目眩、须发早白。（2）阴虚血热之吐血、衄血、尿血、便血、崩漏。天门冬（A错）即天冬。天冬：【主治病证】（1）肺热燥咳，顿咳痰黏，劳嗽咯血。（2）骨蒸潮热，津伤口渴，阴虚消渴。（3）肠燥便秘。百合（B错）：【主治病证】（1）肺虚久咳，阴虚燥咳，劳嗽咯血。（2）虚烦惊悸，失眠多梦，精神恍惚。玉竹（C错）：【主治病证】（1）肺燥咳嗽，阴虚劳嗽，阴虚外感。（2）胃阴耗伤之舌干口燥，消渴。桑椹（D错）：【主治病证】（1）阴虚血亏之眩晕、目暗、耳鸣、失眠、须发早白。（2）津伤口渴，消渴。（3）肠燥便秘。